含挥发油多的药材和饮片，如薄荷、当归、川芎等，应贮于
A. 阴凉、通风处
B. 密闭、阴凉处
C. 阴凉、干燥处
D. 通风、干燥处
E. 密封、凉暗处

正确答案：C。阴凉、干燥处

解析：本题考查的是中药饮片的贮藏要求。含挥发油多的药材和饮片，如薄荷、当归、川芎等，应贮于阴凉、干燥处（C对）。含挥发油多的药材和饮片，如薄荷、当归、川芎、荆芥等，贮藏时室温不可太高，否则容易走失香气或泛油，应置阴凉、干燥处贮存。动物类药材主要有皮、骨、甲、蛇虫躯体，易生虫和泛油，并且有腥臭气味。应密封保存，四周无鼠洞，并有通风设备，阴凉（A错）贮存。含糖分及黏液质较多的饮片，如肉苁蓉、熟地黄、天冬、党参等，应贮于通风干燥处。加酒炮制的当归、常山、大黄等饮片，加醋炮制的芫花、大戟、香附、甘遂等饮片，均应贮于密闭容器中，置阴凉处（B错）贮存。含糖分及黏液质较多的饮片，如肉苁蓉、熟地黄、天冬、党参等，应贮于通风干燥处（D错）。某些矿物类饮片如硼砂、芒硝等，在干燥空气中容易失去结晶水而风化，故应贮于密封的缸、罐中，并置于凉爽处（E错）贮存。